机会致病菌的致病条件为
A. 菌群失调
B. 寄生异位
C. 机体免疫力低下
D. A+C
E. A+B+C

正确答案：E。A+B+C

解析：机会致病菌的致病条件:①菌群失调:机体某部位正常菌群中各菌种间的比例发生大的改变。②寄生异位:如某些大肠埃希菌是肠道内的常见菌，当它们进入泌尿道，就会引起泌尿道感染；进入腹腔，可引起化脓性腹膜炎等。③机体免疫力低下:包括使用大剂量皮质激素、抗肿瘤药物和放射治疗时，以及重症患者如AIDS患者和晚期肿瘤患者。掌握“细菌的分类”知识点。